月经先期的原因为
A. 邪热迫血妄行
B. 肝气郁滞
C. 寒凝气滞
D. 脾肾虚损
E. 瘀血积滞

正确答案：A。邪热迫血妄行

解析：本题考查的是经期异常变化的临床意义。月经先期的原因为邪热迫血妄行（A对）。经期异常变化的临床意义：月经一般以28天至30天为一个周期，若提前八九天以上者，为月经先期，多因邪热迫血妄行，或因气虚不能摄血，血行无制，属于肝郁或瘀血的亦较多见。若周期错后八、九天以上者，为月经后期，多因寒凝气滞（C错），血不畅行，或因血少，任脉不充，也常见于痰阻或气滞血瘀。若经期错乱，或前或后，经行无定期，多因肝气郁滞（B错），或因脾肾虚损（D错），也有因瘀血积滞（E错）所致。还有极少数妇女终身不见月经，但也能正常妊娠生育的，称为“暗经”，属于生理上的异常，不作病论。